据统计，我国城市人群前五位死因，1957年依次为：呼吸系统疾病、传染病、消化系统疾病、心脏病、脑血管病。到1985年前五位死因顺位变为：心脏病、脑血管病、恶性肿瘤、呼吸系统疾病、消化系统疾病。根据社会医学理论，针对这些变化，下列描述不恰当的是
A. 疾病谱、死因谱发生了变化
B. 病因研究应当由单因素向多因素转变
C. 促进了医学模式的转变
D. 人群疾病频率与严重程度增加
E. 应注重心理、社会因素对健康的影响

正确答案：D。人群疾病频率与严重程度增加

解析：本题考查社会医学理论。根据本题中前五位死因顺位的变化，可得出疾病谱、死因谱发生了变化（A对）；病因研究应当由单因素向多因素转变（B对）；促进了医学模式的转变（C对）；应注重心理、社会因素对健康的影响（E对）。判断人群疾病频率常用的指标有两周患病率、慢性病患病率、健康者占总人口百分比。判断疾病严重程度常用的指标有两周卧床率、两周活动受限率、两周休工（学）率、两周患病天数、失能率、残障率、两周卧床天数、休工天数、休学天数等（D错，为本题正确答案）。